在氯霉素滴眼剂处方中,下列物质的作用是：羟苯丙酯
A. 渗透压调节剂
B. 抑菌剂
C. 抗氧剂
D. 金属离子络合剂
E. pH调节剂

正确答案：D。金属离子络合剂